乳酸血症禁用的是
A. 胃蛋白酶
B. 多潘立酮
C. 洛哌丁胺
D. 乳果糖
E. 伪麻黄碱

正确答案：D。乳果糖

解析：本题考查药物的禁忌症。乳酸血症禁用的是乳果糖（D对）。乳果糖在结肠中被消化道菌丛转化成低分子量有机酸，故乳酸血症患者服用乳果糖可加重酸中毒，因此乳果糖禁用于乳酸血症患者。胃蛋白酶（A错）禁用于胃肠道出血患者。多潘立酮（B错）为促胃肠动力药，禁用于嗜铬细胞瘤、乳癌、机械性肠梗阻、胃肠出血患者。洛哌丁胺（C错）不应用于肠梗阻、亚肠梗阻或便秘病人。伪麻黄碱（E错）是α受体激动剂，α受体激动剂能收缩平滑肌，即能收缩膀胱颈，从而加重膀胱颈梗阻，故膀胱颈梗阻禁用伪麻黄碱。